下列各项，不属于涩脉的主病是
A. 气虚
B. 伤精
C. 血少
D. 痰食内停
E. 气滞血瘀

正确答案：A。气虚

解析：涩脉的脉象特点是形细而行迟，往来艰涩不畅，脉势不匀，多见于气滞、血瘀、痰食内停和精伤、血少。气滞、血瘀（E对）、痰浊、宿食（D对）等邪气内停，阻滞脉道，气机不畅，血行瘀滞，以致脉气往来艰涩，此系实邪内盛，正气未衰，故脉涩而有力；精伤（B对）血少（C对），津液耗伤，不能充养脉道，久而脉失濡润，气血运行不畅，以致脉气往来艰涩而无力。微脉多见于气血大虚，阳气衰微（A错，为本题正确答案）。